男性，乙肝表面抗原阳性多年，近期出现肝区痛、纳差、消瘦，查体肝大（肋下4cm）质硬，肝边缘不整，最有可能的诊断是
A. 急性肝炎
B. 慢性活动性肝炎
C. 大结节性肝硬化
D. 原发性肝癌
E. 肝脓肿

正确答案：D。原发性肝癌

解析：患者既往有乙肝病史多年（肝炎发展三部曲：肝炎→肝硬化→肝癌，有可能发展为肝癌），近期出现肝区痛（肝癌最常见的症状）、纳差、消瘦等症状（肝癌的全身性表现），肝大、质硬、肝边缘不整（肝癌最常见的体征），符合原发性肝癌（D对）的诊断标准。急性肝炎（A错）病程一般在半年内；慢性活动性肝炎（B错）主要表现为弥漫性肝肿大，均不会出现肝脏质硬、边缘不整。大结节性肝硬化（C错）的肝脏一般正常或缩小。肝脓肿（E错）一般起病较急，全身症状较重，常伴寒战高热。